治疗由于呼吸道合胞病毒引起的肺炎和支气管炎效果最佳的是
A. 氟康唑
B. 异烟肼
C. 甲硝唑
D. 庆大霉素
E. 利巴韦林

正确答案：E。利巴韦林

解析：利巴韦林对于呼吸道合胞病毒引起的肺炎和支气管炎效果最佳。掌握“氟康唑、利巴韦林及阿昔洛韦”知识点。